消渴病的病机是
A. 肺阴虚弱，津液不足
B. 胃阴不足，阴虚火旺
C. 肾阳虚弱，精津不足
D. 阴亏津损，燥热偏盛
E. 肝肾阴虚，虚火上扰

正确答案：D。阴亏津损，燥热偏盛

解析：消渴病是由于阴亏燥热，五脏虚弱所致的以多饮、多食、多尿、形体消瘦为特征的病证。其病位在肺、胃、肾，其病机主要在于阴津亏损，燥热偏盛，阴虚为本，燥热为标（D对）。